将下颌磨牙的牙周组织破坏较严重的一个根连同该半侧牙冠一起切除，成为一个“单根牙”，从而消除根分叉病变，属于根分叉病变的哪种治疗方式
A. 分根术
B. 牙半切术
C. 翻瓣植骨术
D. 引导性组织再生术
E. 截根术

正确答案：B。牙半切术

解析：牙半切除术又称半切除术，是将下颌磨牙的牙周组织破坏较严重的一个根连同该半侧牙冠一起切除，而保留病变较轻或正常的半侧，成为一个“单根牙”，从而消除根分叉病变。掌握“根分叉病变”知识点。